马斯洛认为需要的最高层次为
A. 归属与爱
B. 自我实现
C. 尊重
D. 安全
E. 生理

正确答案：B。自我实现